通过肩关节囊内的肌腱是
A. 冈上肌腱
B. 冈下肌腱
C. 肱三头肌长头腱
D. 肱二头肌长头腱
E. 肱二头肌短头腱

正确答案：D。肱二头肌长头腱

解析：肩关节囊内有肱二头肌长头腱（D对）穿过。